男，68岁。2型糖尿病病史14年，血压升高7年，视物模糊3年，渐进性水肿1年。BP170/95mmHg。尿RBC（-），尿蛋白3.8g/d，血肌酐182μmol/L，B超示双肾大小正常。最可能的临床诊断是
A. 急性肾小球肾炎
B. 慢性肾小球肾炎
C. 原发性肾病综合征
D. 高血压肾损害
E. 糖尿病肾病

正确答案：E。糖尿病肾病

解析：老年男性患者，2型糖尿病多年病史，血压升高7年，视物模糊3年（可疑糖尿病视网膜病变），渐进性水肿1年、高血压、尿蛋白达肾病综合征范围（＞3.5g/d）、血肌酐轻度升高（正常范围为88.4～176.8μmol/L）提示患者可能并发糖尿病肾病（E对），糖尿病肾病与视网膜病变均为糖尿病微血管病变，二者可同时或先后出现。急性肾小球肾炎（A错）多有感染诱因，常为急性起病，几乎所有患者均有肾小球源性血尿，可伴有轻、中度蛋白尿，肾病综合征范围内的大量蛋白尿少见。慢性肾小球肾炎（B错）常有高血压、水肿、蛋白尿、血尿，双侧肾脏多缩小。原发性肾病综合征（C错）诊断的两个必备条件是尿蛋白＞3.5g/d及血浆白蛋白＜30g/L（P470），本例未述及患者血浆白蛋白的测定值，且患者合并糖尿病视网膜病变，诊断糖尿病肾病更合理。高血压肾损害（D错）常有多年高血压病史，很少出现明显蛋白尿，肾功能减退首先从肾小管浓缩功能开始，肾小球滤过功能可长期保持正常或增强（P259）。